异戊巴比妥的成人一次剂量为140mg，则体重为20kg小儿一次剂量应是
A. 5mg
B. 10mg
C. 20mg
D. 40mg
E. 80mg

正确答案：D。40mg

解析：本题考查儿童用药。根据公式：小儿剂量=成人剂量×小儿体重（kg）/70，可知体重为20kg的患儿使用的剂量为：140×20/70=40mg（D对）。